患者男性，24岁。腹部被倒墙压伤，中腹部剧痛伴呕吐3小时。血压120/86mmHg，体温38℃，腹胀、肌紧张、压痛、反跳痛阳性，肠鸣音消失。最可能的诊断是
A. 腹壁挫伤
B. 腹膜后血肿
C. 肝破裂
D. 小肠破裂
E. 右肾挫伤

正确答案：D。小肠破裂

解析：本例患者为青年男性，腹部被压伤后出现中腹部剧痛伴呕吐、腹胀、发热，查体可见腹膜刺激征阳性、肠鸣音消失，血压120/86mmHg，提示血压正常，说明没有合并急性大失血，故最可能的诊断是小肠破裂（D对）导致急性弥漫性腹膜炎。腹壁挫伤（A错）是腹部外伤中较轻的损伤，主要表现为伤部肿胀、皮下淤血、局部疼痛，有压痛，一般不会出现反跳痛和肠鸣音消失。腹膜后血肿（B错）多是高处坠落、挤压、车祸等所致腹膜后脏器（胰、肾）损伤、骨盆或下段脊柱骨折和腹膜后血管损伤引起的，主要表现为内出血征象、腰背痛和肠麻痹。肝破裂（C错）主要表现为腹腔内出血，包括面色苍白、脉率加快、血压不稳，甚至休克，若伴有较大肝内胆管破裂时，则可出现明显腹痛和腹膜刺激征。右肾挫伤（E错）主要表现为右侧腰痛、血尿，一般不会出现腹膜刺激征阳性和肠鸣音消失。